最常用于诊断颌骨恶性肿瘤的放射性核素是
A. 131I（碘）
B. 32P（磷）
C. 35Sr（锶）
D. 67Ga（镓）
E. 99mTc（锝）

正确答案：E。99mTc（锝）

解析：最常用于诊断颌骨恶性肿瘤的放射性核素是99mTc。掌握“口腔颌面部肿瘤的概念、临床表现、诊断”知识点。